55岁女性，绝经3年，近半年偶有性生活后阴道少量流血，无腹痛等其他不适症状。到医院检查发现HPV阳性。对该妇女最应该考虑的疾病是
A. 子宫内膜癌
B. 宫颈癌
C. 卵巢肿瘤
D. 输卵管癌
E. 子宫肌瘤

正确答案：B。宫颈癌